欲评价某市某6岁男童的身高是否在正常范围内，可依据
A. 点估计
B. 区间估计
C. 假设检验
D. 医学参考值范围
E. 均数的标准误

正确答案：D。医学参考值范围